女，29岁，孕40周。宫缩3小时，宫口开6CM。破膜后突发呼吸困难，发绀，数分钟后死亡。诊断为
A. 前置胎盘
B. 先兆流产
C. 癫痫
D. 羊水栓塞
E. 先兆子宫破裂

正确答案：D。羊水栓塞

解析：患者女，29岁，孕40周。宫缩3小时，宫口开6CM。破膜后（羊水栓塞的病因）突发呼吸困难，发绀，数分钟后死亡（羊水栓塞的表现），结合患者的病因和表现，诊断为羊水栓塞（D对）。（P147）前置胎盘 典型症状是妊娠晚期或临产后发生无诱因、无痛性反复阴道流血（A错）。（P71）先兆流产 指妊娠 28 周前先出现少量阴道流血，常为暗红色或血性白带，无妊娠物排出，随后出现阵发性下腹痛或腰背痛。妇科检查宫颈口未开，胎膜未破，子宫大小与停经周数相符（B错）。（P212）先兆子宫破裂常见于产程长、有梗阻性难产因素的产妇。表现为：①子宫呈强直性或痉挛性过强收缩，产妇烦躁不安，呼吸、心率加快，下腹剧痛难忍。②因胎先露部下降受阻，子宫收缩过强，子宫体部肌肉增厚变短，子宫下段肌肉变薄拉长，在两者间形成环状凹陷，称为病理缩复环。随着产程进展，可见该环逐渐上升平脐或脐上，压痛明显。③膀胱受压充血，出现排尿困难及血尿。④因宫缩过强、过频，无法触清胎体，胎心率加快或减慢或听不清（E错）。